按照《母婴保健法》规定，属于婚前医学检查的疾病有
A. 严重传染病
B. 法定传染病
C. 指定传染病
D. 重性精神病
E. 肿瘤

正确答案：C。指定传染病